不符合新生儿生理性黄疸的原因是
A. 红细胞的寿命短
B. 红细胞数量多
C. 红细胞内酶发育不成熟
D. 肠道内正常菌群尚未建立
E. 肝功能不成熟

正确答案：C。红细胞内酶发育不成熟

解析：红细胞内酶发育不成熟是病理性黄疸常见的原因，而不是生理性黄疸的原因（C错，为本题正确答案）。红细胞的寿命短（足月儿为80天），因此红细胞破坏快，胆红素增多，从而引起生理性黄疸（A对）。胎儿血氧分压低，会有红细胞数量多（代偿性增多），出生后血氧分压增高，大量红细胞破坏，胆红素生成增多，形成生理性黄疸（B对）。肠道内正常菌群尚未建立，导致结合胆红素生成障碍，血清未结合胆红素增多，产生生理性黄疸（D对）。新生儿肝功能不成熟，处理胆红素的能力差，当然会形成生理性黄疸（E对）。